对深部真菌有效的药物有
A. 酮康唑
B. 氟康唑
C. 克霉唑
D. 两性霉素B
E. 灰黄霉素

正确答案：A、B、C、D。酮康唑；氟康唑；克霉唑；两性霉素B

解析：本题考查对深部真菌有效的药物。抗深部真菌感染的药物：1.两性霉素B（D对）：主要用于治疗全身性真菌感染——首选。2.氟胞嘧啶：抗深部真菌药，前体药。3.唑类抗真菌药（1）酮康唑（A对）；（2）氟康唑（B对）；（3）伊曲康唑；（4）克霉唑（C对）。灰黄霉素（E错）为非多烯类抗真菌抗生素，可以有效的治疗浅部真菌病,对念珠菌属及深部真菌感染无效。